某病病变处溃疡呈火山口状，深达骨面，但不破坏骨组织，溃疡中心坏死，周围黏膜充血，有自愈倾向，病程一般为6～8周，此病为
A. 复发性阿弗他溃疡
B. 天疱疮
C. 坏死性唾液腺化生
D. 鳞状细胞癌
E. 黏液表皮样癌

正确答案：C。坏死性唾液腺化生

解析：坏死性唾液腺化生的特征为黏膜表面形成火山口样溃疡，溃疡可深达骨面，但不破坏骨组织，溃疡中心坏死，周围黏膜充血，亦有少数不出现溃疡，仅表面黏膜发红肿胀者。掌握“坏死性唾液腺化生与舍格伦综合征”知识点。